女，55岁，里急后重伴排便不尽感5个月，大便带血近1个月，查体：T36.5℃，P80次/分，R18次/分，BP120/80mmHg，双肺呼吸音清，未闻及干湿啰音，心、率80次/分，心律齐，腹软，无压痛，直肠指诊：膝胸位，进指6cm，于直肠右侧壁触及柔软光滑有包块。对于诊断最有意义的检查是
A. 经阴道B超
B. 盆腔CT
C. 结肠X线钡灌肠检查
D. 经直肠B超
E. 结肠镜

正确答案：E。结肠镜

解析：患者中年女性，里急后重伴排便不尽感5个月（提示直肠刺激征），大便带血近1个月（提示癌肿破溃症状），直肠指诊：膝胸位，进指6cm，于直肠右侧壁触及柔软光滑有包块（诊断直肠癌的最重要的方法，提示直肠有肿物）。根据患者的临床症状和辅助检查，可考虑诊断为直肠癌。对于直肠癌的确诊，常用检查方法有大便潜血检查、直肠指诊、结肠镜检查（E对）。经阴道B超（A错）可发现子宫肌瘤、子宫内膜癌、卵巢肿瘤、输卵管积水等妇科疾病，尤其对子宫内膜癌、宫外孕等诊断具有重要价值。盆腔CT（B错）是为了明确盆腔的病变，如膀胱肿瘤、前列腺癌、子宫和附件病变临床和超声检查不满意者、子宫肌瘤等疾病的诊断。结肠X线钡灌肠检查（C错）是结肠癌的重要检查方法，对直肠癌的诊断意义不大。经直肠B超（D错）常用于前列腺的检查。